用麦芽酚反应鉴别硫酸链霉素时，所用的试剂有
A. 氢氧化钠试液
B. 硫酸铁铵溶液
C. 硝酸
D. 硝酸银试液
E. 碱性酒石酸铜试液

正确答案：A、B。氢氧化钠试液；硫酸铁铵溶液